心力衰竭细胞是
A. 肺褐色硬化内含铁血黄素的嗜酸性粒细胞
B. 肺褐色硬化内含铁血黄素的淋巴细胞
C. 肺褐色硬化内含铁血黄素的中性粒细胞
D. 肺褐色硬化内含铁血黄素的巨噬细胞
E. 肺褐色硬化内含铁血黄素的嗜碱性粒细胞

正确答案：D。肺褐色硬化内含铁血黄素的巨噬细胞

解析：心力衰竭细胞是指肺褐色硬化（肺淤血性硬化）时，肺泡腔内所见的含有含铁血黄色的巨噬细胞（D对）。